属于5α受体还原酶抑制剂的抗良性前列腺素增生症的药品是
A. 酚妥拉明
B. 度他雄胺
C. 普适泰
D. 特拉唑嗪
E. 肾上腺素

正确答案：B。度他雄胺

解析：本题考查抗前列腺增生症药。属于5α受体还原酶抑制剂的抗良性前列腺素增生症的药品是度他雄胺（B对）。度他雄胺为5α受体还原酶抑制剂，主要用于良性前列腺增生治疗。酚妥拉明（A错）为α受体拮抗剂。普适泰（C错）为植物制剂。特拉唑嗪（D错）是α₁受体阻断剂。肾上腺素（E错）为α、β受体激动剂。